上颌尖牙牙冠唇面形态中哪一点是错误的
A. 圆五边形
B. 近、远中斜缘在牙尖顶端相交约为90°
C. 牙尖偏近中
D. 外形高点在颈1/3与中1/3交接处
E. 发育沟不明显

正确答案：E。发育沟不明显

解析：本题考查牙体解剖外形。发育沟不明显（E错，为本题正确答案）不符合上颌尖牙牙冠唇面形态特点，上颌尖牙唇轴嵴两侧各有一条发育沟，该嵴将唇面分为近中唇斜面和远中唇斜面。上颌尖牙牙冠唇面形态有：似圆五边形（A对），颈缘呈弧形，近中缘长，近中斜缘短，远中斜缘长，远中缘短。近、远中斜缘在牙尖顶端相交成的角约为90度（B对），唇轴嵴两侧各有一条发育沟，该嵴将唇面分为近中唇斜面和远中唇斜面。远中牙尖嵴大于近中牙尖嵴，牙尖顶偏近中（C对）。外形高点在中1/3 与颈1/3交界处的唇轴嵴上（D对）。